不属于公共卫生伦理要求的是
A. 爱岗敬业，宜传大卫生观，言传身教
B. 改善工作和学习环境，严把防疫和食品卫生观
C. 严格监管，控制污染，保护生态环境，促进社会文明，科学严谨，实事求是，信息透明公开
D. 防疫工作者有权在疫区切断传染病传播途径的各种措施
E. 提高社区服务水平，保障妇女儿童和老年人权益

正确答案：D。防疫工作者有权在疫区切断传染病传播途径的各种措施